正值夏秋季节，一位4个月小儿的母亲向医生咨询如何预防佝偻病。医生首选的指导应是
A. 多吃富含维生素D的食物
B. 多吃富含钙的食物
C. 多晒太阳
D. 每日口服钙剂
E. 肌肉注射维生素D

正确答案：C。多晒太阳

解析：本题考查维生素D缺乏性佝偻病的预防与控制。婴幼儿提倡夏秋季节多晒太阳（C对ABDE错），冬春季节额外补充维生素D。夏秋季节平均户外活动时间应在每天1～2小时，可以预防佝偻病。